下列表现中，诊断早期妊娠最可靠的依据是
A. 妇科检查双合诊子宫变软
B. 厌恶油腻，恶心，晨起呕吐
C. 乳房出现蒙氏结节
D. 子宫增大变软与停经月份相符
E. 尿频，无尿急

正确答案：D。子宫增大变软与停经月份相符

解析：输卵管妊娠早期，尚未发生流产或破裂时，过程与早孕相似，因合体滋养细胞产生hCG维持黄体生长，使甾体激素分泌增加，致月经停止来潮，子宫增大变软，出现早孕反应及乳房蒙氏结节，前倾增大的子宫在盆腔内压迫膀胱致尿频，这些都是早期妊娠的症状与体征，但不是最可靠的诊断依据（ABCE错）。早期妊娠时子宫增大变软与停经月份相符，而异位妊娠一般于6周左右破裂（P52）（多见于输卵管峡部妊娠），8～12周流产（多见于输卵管壶腹部妊娠），且早期子宫大小与停经周数不相符，所以是子宫增大变软与停经月份相符（D对）是诊断早期妊娠最可靠的依据。